《中国药典》中，测定硫酸阿托品含量的方法是
A. 红外分光光度法
B. 紫外-可见光分光光度法
C. 薄层色谱法
D. 非水溶液滴定法
E. 氧化还原滴定法

正确答案：D。非水溶液滴定法

解析：本题考查非水溶液滴定法。《中国药典》记载测定阿托品含量采用非水溶液滴定法（D对）。红外分光光度法（A错）应用最广泛的是对未知毒物的结构分析、纯度鉴定。紫外-可见光分光光度法（B错）用于鉴别、杂质检查和定量测定。薄层色谱（C错）是快速分离和定性分析少量物质的实验技术，属固-液吸附色谱。氧化还原滴定法（E错）是以溶液中氧化剂和还原剂之间的电子转移为基础的一种滴定分析方法